以上哪种疾病是属于梅-罗综合征的其中一种特征
A. 放射性骨髓炎
B. 结核性骨髓炎
C. 慢性局灶性硬化性骨髓炎
D. 肉芽肿性唇炎
E. 急性化脓性骨髓炎

正确答案：D。肉芽肿性唇炎

解析：梅-罗综合征：其特征为肉芽肿性唇炎伴有面神经麻痹和沟纹舌。掌握“结核性骨髓炎及放射性骨髓炎”知识点。